颌面部无菌创口一般的处理原则是
A. 每日更换敷料
B. 创口湿敷
C. 创口冲洗
D. 创口严密缝合，早期暴露
E. 大剂量应用抗生素

正确答案：D。创口严密缝合，早期暴露

解析：本题考查清洁创口的处理原则。颌面部创口分为无菌创口、污染创口、感染创口三种。无菌创口一般应争取严密缝合，可早期暴露（D对），及时清除渗出物。无菌创口除为拔除引流物及怀疑已有感染者外，一般不轻易打开敷料（A错），以避免污染。对于感染创口可根据创口的情况进行湿敷（B错）、冲洗（C错）。污染创口和感染创口均可根据具体情况使用抗生素（E错）。